男性，65岁。近2年来右上肢抖动，动作迟缓面容呆板，行走起步困难，查体右上下肢肌张力增高，齿轮样动作。该患者发病机制可能是
A. 纹状体区内乙酰胆碱含量增加，使多巴胺含量减少
B. 纹状体区内多巴胺受体敏感性增加
C. 黑质区多巴胺脱羧酶增多
D. 黑质区单胺氧化酶减少
E. 黑质区酪氨酸羧化酶减少

正确答案：E。黑质区酪氨酸羧化酶减少